患者，男，身高180cm，体重90KG，腰围100cm，体重指数（BMI）是
A. 18
B. 20
C. 27.8
D. 30.2
E. 34.2

正确答案：C。27.8

解析：本题考查体重指数。患者，男，身高180cm，体重90KG，腰围100cm，体重指数（BMI）是27.8（C对）。体重指数（BMI）=体重（kg）/身高²（m²），该患者体重指数=90/1.8²=27.8。